有机酸的pKa﹤3或有机碱的pKa﹥8时不易吸收
A. 脂/水分配系数与毒效应
B. 电离度与毒效应
C. 挥发度和蒸汽压与毒效应
D. 分散度与毒效应
E. 纯度与毒效应

正确答案：B。电离度与毒效应